不能屈腕的肌肉是
A. 肱桡肌
B. 掌长肌
C. 拇长屈肌
D. 指深屈肌
E. 无

正确答案：A。肱桡肌

解析：肱桡肌（A错，为本题正确答案）的作用是屈肘关节和旋后处于旋前位的前臂，而无屈腕功能。掌长肌（B对）、拇长屈肌（C对）和指深屈肌（D对）均有屈腕的功能。